关于掌跖角化-牙周破坏综合征描述错误的是
A. 皮肤和牙周病变多在4岁前共同出现
B. 患儿智力障碍但身体发育正常
C. 既侵犯乳牙又侵犯恒牙
D. 有深牙周袋，牙槽骨吸收迅速
E. 对常规牙周治疗疗效不佳

正确答案：B。患儿智力障碍但身体发育正常

解析：发生掌跖角化-牙周破坏综合征的患儿智力发育多为正常。故答案为B。掌握“反应全身疾病的牙周炎”知识点。